关于HACCP系统的描述正确的是
A. 企业的最高管理者构成HACCP工作组
B. 由一线生产操作人员绘制产品加工流程图
C. 一个关键控制点控制一个危害
D. 只要措施有效就可以被确定为关键控制点
E. 在一个具体步骤上可有多个关键限值

正确答案：E。在一个具体步骤上可有多个关键限值